单个乳磨牙早失，间隙两侧的牙齿近缺隙面有邻面龋波及牙髓需做根管治疗者，应选择
A. 带环（全冠）丝圈保持器
B. Nance腭弓式间隙保持器
C. 远中导板保持器
D. 充填式保持器
E. 可摘式功能性保持器

正确答案：D。充填式保持器

解析：充填式保持器适应证：单个乳磨牙早失，间隙两侧的牙齿近缺隙面有邻面龋波及牙髓需做根管治疗者。掌握“乳牙早失及间隙管理”知识点。